醋酸氢化可的松溶液中作为防腐剂的是
A. 硫柳汞
B. 氯化钠
C. 聚山梨酯80
D. 羟甲基纤维素钠
E. 注射用水

正确答案：A。硫柳汞

解析：本题考查用作滴眼剂防腐剂的辅料。硫柳汞（A对）在醋酸氢化可的松溶液中作为防腐剂；氯化钠（B错）一般为渗透压调节剂；聚山梨酯80（C错）可作为乳化剂、增溶剂；羟甲基纤维素钠（D错）可作助悬剂；注射用水（E错）作为溶剂。